单环β-内酰胺类抗生素是
A. 氨苄西林
B. 舒巴坦钠
C. 头孢氨苄
D. 亚胺培南
E. 氨曲南

正确答案：E。氨曲南

解析：本题考查氨曲南。氨曲南（E对）属于单环β-内酰胺类抗生素，对G⁻有强大抗菌作用，对G⁺、厌氧菌作用弱。氨苄西林（A错）属于青霉素类抗生素药物，通过干扰敏感细菌细胞壁黏肽的合成使细菌失去细胞壁的屏障作用。舒巴坦钠（B错）属于青霉烷砜类结构，可与其它β内酰胺类抗生素合用，产生抗菌协同作用。头孢氨苄（C错）属于第一代头孢菌素类抗菌药物，临床用于敏感菌株所致的轻、中度感染。亚胺培南（D错）是碳青霉烯类抗菌药物。临床常用其和脱氢肽酶抑制剂西司他丁的复方制剂，用于多种病原体所致和需氧/厌氧菌引起的混合感染以及在病原菌未确定时的早期治疗。